关于胸腰椎chance骨折叙述错误的是
A. 为椎体水平状撕裂性损伤
B. 损伤机制较为复杂，不只是发生在系有安全带的交通伤中
C. 是一种稳定性脊柱骨折
D. 临床上比较少见
E. 短阶段螺丝钉治疗可重建脊柱的稳定性

正确答案：C。是一种稳定性脊柱骨折

解析：Chance骨折是指经椎体、椎弓及棘突的横向骨折，为椎体水平状撕裂性损伤（A对）。由于累及前中后三柱，骨折端易发生移位，故属于不稳定性骨折（C错，为本题正确答案）。其损伤机制较为复杂，不只是发生在系有安全带的交通伤中，还可发生于重物砸伤、高空坠落中（B对），临床上比较少见（D对），短阶段螺丝钉治疗可重建脊柱的稳定性，恢复脊柱的序列，获得较好疗效（E对）。